宜于清晨服用的药品是
A. 呋塞米
B. 普伐他汀
C. 甲氧氯普胺
D. 格列美脲
E. 阿司匹林

正确答案：A。呋塞米

解析：本题考查药品服用的适宜时间。呋塞米（A对）为利尿药，宜于清晨服用，避免夜间排尿次数过多。普伐他汀（B错）宜睡前服用，因为肝脏合成胆固醇高峰期多在夜间。甲氧氯普胺（C错）为促胃动力药，餐前服用可助消化。格列美脲（D错）为降糖药，宜于餐中服用。阿司匹林（E错）宜于餐后服用，可减少对胃肠道的刺激。